大承气汤用治热厥，体现的治法是
A. 通因通用
B. 寒因寒用
C. 热因热用
D. 塞因塞用
E. 以泻代清

正确答案：B。寒因寒用

解析：大承气汤用治热厥，体现的治法是寒因寒用（B对）。通因通用之法在芍药汤中应用（A错）。热因热用之法在白通汤中应用（C错）。塞因塞用之法在半夏泻心汤中使用（D错）。以泻代清之法在凉膈散中使用（E错）。